下列关于中药材种植、养殖管理的说法，正确的是
A. 在药用动物的养殖中，适时、定量地补充精料、维生素、矿物质及其他必要的添加剂，可以适量添加激素类药品
B. 根据药用植物的营养特点及土壤的供肥能力，确定施肥种类、时间和数量
C. 严格管理农药、肥料等农业投入品的使用，禁止在中材种植过程中使用剧毒、高毒农药
D. 种子、菌种和繁殖材料在生产、储运过程中应实行验检疫制度以保证质量和防止病虫害及杂草的传播

正确答案：B、C、D。根据药用植物的营养特点及土壤的供肥能力，确定施肥种类、时间和数量；严格管理农药、肥料等农业投入品的使用，禁止在中材种植过程中使用剧毒、高毒农药；种子、菌种和繁殖材料在生产、储运过程中应实行验检疫制度以保证质量和防止病虫害及杂草的传播

解析：本题考查中药的保护与发展。下列关于中药材种植、养殖管理的说法，正确的是根据药用植物的营养特点及土壤的供肥能力，确定施肥种类、时间和数量（B对）、严格管理农药、肥料等农业投入品的使用，禁止在中材种植过程中使用剧毒、高毒农药（C对）、种子、菌种和繁殖材料在生产、储运过程中应实行验检疫制度以保证质量和防止病虫害及杂草的传播（D对）。企业应当根据种植中药材营养需求特性和土壤肥力，科学制定肥料使用技术规程：以有机肥为主，化学肥料有限度使用，鼓励使用经国家批准的微生物肥料及中药材专用肥；自积自用的有机肥须经充分腐熟达到无害化标准，避免掺入杂草、有害物质等；禁止直接施用城市生活垃圾、工业垃圾、医院垃圾和人粪便。第二十二条国家鼓励发展中药材规范化种植养殖，严格管理农药、肥料等农业投入品的使用，禁止在中药材种植过程中使用剧毒、高毒农药，支持中药材良种繁育，提高中药材质量。种子种苗或其他繁殖材料。中药材种子种苗或其他繁殖材料应当符合国家、行业或者地方标准；没有标准的，鼓励企业制定标准，明确生产基地使用种子种苗或其他繁殖材料的等级，并建立相应检测方法。GAP还要求企业应当根据药用动物生长发育习性和对环境条件的要求等制定养殖技术规程。企业应当按国务院农业农村行政主管部门有关规定使用饲料和饲料添加剂；禁止使用国务院农业农村行政主管部门公布禁用的物质以及对人体具有直接或潜在危害的其他物质；不得使用未经登记的进口饲料和饲料添加剂（A错）。